男，28岁。2小时前摔倒后左肩受伤。X线检查示左盂肱关节失去正常对应关系，未见骨折征象。予手法复位，复位成功的标志是
A. Mills征阴性
B. Dugas征阴性
C. 肩胛盂处有空虚感
D. 方肩
E. 弹性固定

正确答案：B。Dugas征阴性

解析：患者左肩摔伤，X线示左盂肱关节失去正常对应关系，未见骨折征象，应诊断为左肩关节脱位。Dugas征阳性、肩胛盂处有空虚感、方肩和弹性固定均为肩关节脱位的典型体征，故手法复位后这些体征消失（B对CDE错）。Mills征（P719）（伸肌腱牵拉试验）阳性见于肱骨外上髁炎（A错）。